男，6个月。近1个月烦躁、多汗、夜惊。突然两眼上窜神志不清，四肢抽动。持续约1分钟缓解。血清钙1.6mmol/L，血糖4.5mmol/L，考虑诊断为
A. 癫痫
B. 化脓性脑膜炎
C. 低血糖
D. 低钙惊厥
E. 高热惊厥

正确答案：D。低钙惊厥

解析：患儿考虑诊断为低钙惊厥的原因是血钙为1.6mmol/L（血钙正常值为2.25～2.75mmol/L，儿童稍高），低于1.75mmol/L，且四肢抽动（D对）。患儿没有出现持续存在的反复癫痫发作（A错）。患儿没有出现感染中毒及急性脑功能障碍症状、颅内压增高表现、脑膜刺激征的化脓性脑膜炎的典型临床表现（B错）。患儿血糖4.5mmol/L（血糖正常值为3.9～6.0mmol/L），大于2.2mmol/L（C错），且大多数低血糖患儿无临床症状。高热惊厥为体温在38℃以上时（P376），突然出现惊厥（E错），需要在排除颅内感染和其他导致惊厥的器质性或代谢性疾病，并且既往没有无热惊厥史，才可诊断为热性惊厥。